女，20岁，反复高热伴游走性关节痛，口腔干燥、溃疡，脱发月余，化验尿蛋白++，颗粒管型5个/HP，间断有血尿，类风湿因子1：20（+），抗SSA抗体阳性，抗双链DNA抗体阳性。诊断首先考虑
A. 风湿性关节炎
B. 类风湿关节炎
C. 系统性红斑狼疮
D. 慢性肾小球肾炎急性发作
E. 干燥综合征

正确答案：C。系统性红斑狼疮

解析：年轻女性患者（系统性红斑狼疮好发人群），出现反复高热、游走性关节炎、口腔溃疡、脱发月余（系统性红斑狼疮常见症状），化验出现蛋白尿、管型尿及血尿（系统性红斑狼疮肾损害），抗双链DNA抗体阳性（系统性红斑狼疮特异性抗体），考虑患者最可能的诊断为系统性红斑狼疮（C对）。风湿性关节炎（A错）最常见于5～15岁的儿童和青少年，常有溶血性链球菌感染的前驱症状，以游走性、多发性大关节炎最常见，但抗双链DNA抗体阴性。类风湿关节炎（B错）常表现为对称性、持续性多关节肿痛，肾脏一般不会受累，类风湿因子（RF）阳性，急性活动期补体增高，抗双链DNA抗体阴性。慢性肾小球肾炎急性发作（D错）不会出现关节痛与口腔溃疡，自身抗体一般为阴性。干燥综合征（E错）主要表现为干燥性角结膜炎及口腔干燥症（P829），肾脏损害主要累及远端肾小管，肾小球较少受累，抗SSA抗体可阳性，但抗双链DNA抗体阴性。